参与瞳孔对光反射的没有
A. 视神经
B. 瞳孔括约肌
C. 动眼神经
D. 瞳孔开大肌
E. 睫状神经节

正确答案：D。瞳孔开大肌

解析：瞳孔对光反射的通路如下：视网膜—视神经一视交叉一视束一上丘臂一顶盖前区一两侧动眼神经副核一动眼神经一睫状神经节一节后纤维一瞳孔括约肌收缩一两侧瞳孔缩小。所以瞳孔对光反射没有瞳孔开大肌（D错，为本题正确选项）参与。